健康教育的意义不包括
A. 提高全人类整体的身体素质
B. 消除或降低危险因素，降低发病率、伤残率、死亡率
C. 提高生活和生命质量，并对教育效果作出评价
D. 改善、达到、维持和促进个体和社会健康的一种有效手段
E. 帮助人们建立和选择健康的生活方式

正确答案：A。提高全人类整体的身体素质